好的劳动条件应该是
A. 安全、卫生、满意和高效的
B. 安全、卫生和满意的
C. 既卫生又令人满意的
D. 能保证健康的
E. 能令人满意的

正确答案：A。安全、卫生、满意和高效的